区分渗出液和漏出液的最主要依据是
A. 晶体成分
B. 细胞数目
C. 蛋白质含量
D. 酸碱度
E. 比重

正确答案：C。蛋白质含量

解析：根据蛋白含量（C对）的不同分为漏出液和渗出液。漏出液的特点是水肿液的比重低于1.015，蛋白质的含量低千25g/L；细胞数少于500/100ml，渗出液由于毛细血管通透性增高，水肿液的比重高于1. 018，蛋白质含量可达30 ~50g/L。